某乡有4万人，约1万户。欲抽样调查4000人，按该乡家庭人口登记名册，以户为单位，随机抽取第1户，随后每间隔10户再抽取1户，对被抽到的家庭进行调查。这种抽样方法称为
A. 单纯随机抽样
B. 系统抽样
C. 整群抽样
D. 多级抽样
E. 分层抽样

正确答案：B。系统抽样

解析：随机抽取第1户，随后每间隔10户再抽取1户，这种抽样方法称为系统抽样（B对）。分层抽样（E错）是指先将总体分成若干个次级层，然后在每层内分别进行抽样。